又称风疹块，是一种局限性暂时性水肿的皮疹是
A. 斑疹
B. 玫瑰疹
C. 丘疹
D. 斑丘疹
E. 荨麻疹

正确答案：E。荨麻疹

解析：荨麻疹（E对）又称风团块，是一种局限性暂时性水肿的皮疹，主要表现为边缘清楚的红色或苍白色的瘙痒性皮肤损害。出现得快，消退也快，消退后不留痕迹，主要由皮肤速发型变态反应所致，常见于各种异性蛋白性食物或药物过敏。斑疹（A错）表现为局部皮肤发红，一般不凸出皮肤表面，见于斑疹伤寒、丹毒等。玫瑰疹（B错）为一种鲜红色圆形斑疹，直径2～3mm，为病灶周围血管扩张所致，是伤寒和副伤寒的特征性皮疹。丘疹（C错）除局部颜色改变外，病灶凸出皮肤表面，见于药物疹、麻疹与湿疹等。斑丘疹（D错）的特点为在丘疹周围有皮肤发红的底盘，见于风疹、猩红热和药物疹等。